由成牙骨质细胞形成，常常修复牙骨质吸收或缺陷区和根折区，其中不含插入的Sharpey纤维的牙骨质为
A. 无细胞无纤维牙骨质
B. 无细胞外源性纤维牙骨质
C. 有细胞固有纤维牙骨质
D. 无细胞固有纤维牙骨质
E. 有细胞混合性分层牙骨质

正确答案：C。有细胞固有纤维牙骨质

解析：有细胞固有纤维牙骨质除了参与构成有细胞混合型分层牙骨质外，还是修复性牙骨质的一种形式。它由成牙骨质细胞形成，常常修复牙骨质吸收或缺陷区和根折区，其中不含插入的Sharpey纤维。掌握“牙骨质”知识点。